疾病监测最重要的目的是
A. 向卫生行政部门报告某人群中某病的流行状况
B. 及时掌握疾病的变化趋势，采取控制措施
C. 收集和分析健康资料
D. 消灭传染源
E. 确定致病因素

正确答案：B。及时掌握疾病的变化趋势，采取控制措施

解析：疾病监测与健康相关问题的监测统称为公共卫生监测，公共卫生监测的目的：1.确定主要的公共卫生问题，掌握其分布和趋势；2.查明原因，采取干预措施。3.评价干预措施效果。4.预测疾病流行。5.制定公共卫生策略和措施（B对A错）。收集和分析健康资料（C错）是公共卫生监测的基本过程。消灭传染源（D错）、确定致病因素（E错）属于查明原因、采取干预措施的内容。